小儿患感冒与成人的相同之处是
A. 易见夹痰兼证
B. 易见夹滞兼证
C. 易见夹惊兼证
D. 平素体弱者病情多较重
E. 年龄较大者病情多较重

正确答案：D。平素体弱者病情多较重

解析：小儿为稚阴稚阳之体，但平素体弱者说明先天禀赋不足，难以抵抗邪气，故患病后病情多较重（D对）。小儿肺脏娇嫩，脾常不足，神气怯弱，感邪之后，易出现夹痰、夹滞、夹惊的兼证，而成人肺气已充，脾气较足，不易出现（ABC错）。小儿年龄较大者，其五脏功能较为完善，正气较强，故患病之后，病情较轻（E错）